肾病综合征最重要的诊断依据是
A. 24小时蛋白尿＞3.5g，血浆白蛋白＜30g/L
B. 血浆白蛋白＜30g/L，血胆固醇及甘油三脂升高
C. 24小时尿蛋白＞3.5g，双下肢凹陷性浮肿
D. 24小时尿蛋白＞3.5g，血胆固醇及甘油三脂升高
E. 血胆固醇及甘油三脂升高，双下肢凹陷性浮肿

正确答案：A。24小时蛋白尿＞3.5g，血浆白蛋白＜30g/L

解析：肾病综合征诊断标准是：①尿蛋白大于3.5g/d；②血浆白蛋白低于30g/L；③水肿；④血脂升高。其中尿蛋白大于3.5g/d，血浆白蛋白低于30g/L为诊断所必需（A对）。